能引起大便秘结的病理变化有
A. 实热
B. 气虚
C. 津亏血燥
D. 阳虚寒凝
E. 气机壅滞

正确答案：A、C、D、E。实热；津亏血燥；阳虚寒凝；气机壅滞

解析：本题考查的是大便秘结的病理变化。能引起大便秘结的病理变化有实热（A对）、津亏血燥（C对）、阳虚寒凝（D对）、气机壅滞（E对）。便秘是指粪便在肠内滞留过久，秘结不通，排便周期延长，或周期不长，但粪质干结，排出艰难，或粪质不硬，虽有便意，但排而不畅的疾病。西医学的功能性便秘、肠易激综合征、直肠肛门疾患引起的便秘、药物性便秘等。